“引经报使”药。其病位当在
A. 太阳经
B. 少阳经
C. 阳明经
D. 少阴经
E. 厥阴经

正确答案：B。少阳经

解析：患者偏头痛，符合少阳经在头面部的分布规律，胸闷胁胀，舌边稍赤，脉弦数是肝胆火热作用于人体的表现。柴胡为引经药，主入肝胆经和三焦经。综上所述，病位在少阳经（B对，ACDE错）。